男，66岁。活动后突发左侧胸痛伴呼吸困难1天。既往慢性阻塞性疾病史10余年。查体：R26次/分，BP95/60mmHg。口唇发绀，左肺呼吸音明显减弱，心率102次/分，律齐。为明确诊断，应先采取的检查措施是
A. CT肺动脉造影
B. 胸腔穿刺
C. 支气管镜
D. 胸部X线片
E. 心电图

正确答案：D。胸部X线片

解析：患者为老年男性，既往慢性阻塞性疾病史，活动后突发左侧胸痛伴呼吸困难，口唇发绀，左肺呼吸音明显减弱（为气胸的典型表现），提示自发性气胸。为明确诊断，应先采取的检查措施是胸部X线片（D对），气胸侧透明度增强，无肺纹理，肺萎缩于肺门部，和气胸交界处有清楚的细条状肺边缘，纵隔可向健侧移位。CT肺动脉造影（P101）（A错）是确诊肺血栓栓塞症的一线手段，可准确发现段以上肺动脉内的血栓。支气管镜（C错）用于中央型肺癌的诊断，可确定病变范围，明确手术指征。心电图（E错）用于心脏疾病的诊断，特别是心律失常的诊断。胸腔穿刺（B错）是气胸或者胸腔积液的诊断和治疗方式。